成人急性血吸虫病患者，采用吡喹酮治疗其总剂量为每公斤体重
A. 40mg
B. 60mg
C. 120mg
D. 140mg
E. 180mg

正确答案：C。120mg

解析：吡喹酮毒性小，疗效好，给药方便，适应证广，可用于各期各型血吸虫病患者，是目前用于治疗日本血吸虫病最有效的药物，是很多蠕虫病如日本血吸虫病、并殖吸虫病、华支睾吸虫病、姜片虫病、肠绦虫病的首选药，成年患者采用吡喹酮治疗其总剂量为120mg/kg（C对）。